目前确诊肺血栓栓塞症最常用的手段是
A. CT肺动脉造影
B. 肺通气/灌注核素扫描
C. 磁共振显影
D. 心脏彩超
E. 肺动脉造影

正确答案：A。CT肺动脉造影

解析：螺旋CT是PTE的一线确诊手段，采用特殊操作技术进行CT肺动脉造影（CTPA）（A对），能够准确发现段以上肺动脉内的血栓，①直接征象：肺动脉内的低密度充盈缺损，部分或完全包围在不透光的血流之间（轨道征），或者呈完全充盈缺损，远端血管不显影；②间接征象：肺野楔形密度增高影，条带状高密度区或盘状肺不张，中心肺动脉扩张及远端血管分支减少或消失。肺通气灌注核素扫描（B错）是诊断肺血栓栓塞症的重要诊断方法，但临床检查受到医院设备的限制，并不是最常用的手段。磁共振显影（C错）和磁共振肺动脉造影，可直接显示肺动脉内的栓子及PTE所致的低灌注区，但对肺段以下水平的PTE诊断价值有限。心脏彩超（D错）显示心脏血液流动变化，不显示肺动脉内血流特征。肺动脉造影（E错）是以往诊断PTE的金标准，但随着多排CT肺血管造影的应用，肺动脉造影的这种地位已经被逐渐取代。